患儿，11个月。泄泻2周。起病时每日泻10多次，经治疗大减，但近日仍日行3~4次，大便稀溏色淡，每于食后作泻，面色萎黄，神疲倦怠，舌质淡，苔薄白。其证候是
A. 风寒
B. 湿热
C. 伤食
D. 脾虚
E. 脾肾阳虚

正确答案：D。脾虚

解析：风寒泻以大便清稀夹有泡沫，臭气不甚，肠鸣腹痛为特征，伴有恶寒发热，鼻流清涕，咳嗽的症状，舌质淡，苔薄白（A错）。湿热泻以大便水样，或如蛋花汤样，泻下急迫，量多次频，气味秽臭为特征，伴有呕恶，神疲乏力或发热烦闹，口渴，小便短黄的症状，舌质红，苔黄腻（B错）。伤食泻以大便稀溏，夹有乳凝块或食物残渣，气味酸臭，脘腹胀痛，泻后痛减为特征，舌苔厚腻，或微黄（C错）。题中患儿有泄泻病史，现以大便日行3~4次，每于食后作泻为主症，故诊断为泄泻。患儿泄泻虽经治疗，但小儿脾常不足，故致脾胃虚弱。脾胃虚弱，清阳不升，纳运无权，故食后作泻，大便稀溏色淡，日行3~4次，面色萎黄，神疲倦怠为脾虚不运，生化无源，气血不足所致，舌质淡，苔薄白为脾虚之征，故辨为脾虚泻（D对）。脾肾阳虚泻以久泻，大便澄澈清冷，完谷不化，形寒肢冷为特征，舌淡苔白（E错）。